希恩（Sheehan）综合征属于
A. 下丘脑性闭经
B. 精神性闭经
C. 子宫性闭经
D. 卵巢性闭经
E. 垂体性闭经

正确答案：E。垂体性闭经

解析：希恩综合征为垂体梗死的常见表现，属于垂体性闭经（E对），由于产后大出血休克，导致垂体尤其是腺垂体促性腺激素分泌细胞缺血坏死，引起腺垂体功能低下而出现一系列症状。